制成脂质体以降低药物肾毒性的抗真菌药是
A. 两性霉素
B. 卡泊芬净
C. 氟胞嘧啶
D. 阿糖胞苷
E. 酮康唑

正确答案：A。两性霉素

解析：本题考查两性霉素B。制成脂质体以降低药物肾毒性的抗真菌药是两性霉素B（A对）。为减轻两性霉素B的不良反应，已研制出两性霉素B脂质体用于临床。由于脂质体制剂多分布于肺、肝和脾脏等网状内皮组织，减少了药物在肾脏的分布，可减轻其肾毒性。目前有四种两性霉素B制剂用于临床，包括：传统的两性霉素B（C-AMB）、脂质体两性霉素B（L-AMB）、两性霉素B脂质复合体（ABLC）、两性霉素B胶体分散体（ABCD）。卡泊芬净（B错）、氟胞嘧啶（C错）、酮康唑（E错）均无肾毒性的不良反应。阿糖胞苷（D错）是干扰核酸生物合成的抗肿瘤药物，非抗真菌药物。